第四脑室正中孔位于
A. 第四脑室脉络组织上
B. 上髓帆
C. 下髓帆
D. 第四脑室脉络组织丛
E. 迷走神经背核

正确答案：C。下髓帆

解析：第四脑室正中孔位于下髓帆（C对）；第四脑室脉络组织上（A错）介于下髓帆和菱形窝外下界之间，组成第四脑室顶后下部的大部分，不含神经组织； 脉络组织内的部分血管反复分支，相互缠绕成丛状，夹带着室管膜上皮和软膜突入室腔，成为第 四脑室脉络丛（D错）；上髓帆（B错）为介于两侧小脑上脚之间的薄层白质板，向后下与小脑白质相连，其下部的背面被小脑蟒的小舌覆盖；迷走神经背核（E错）位于延髓迷 走神经三角的深面，舌下神经核的背外侧，由橄榄中部向下延伸至内侧丘系交叉平面 。